男性，22岁，半年前起病，表现：有时头痛头昏，部位不定，未予处理，话多，要办一个1000人的工厂，要当经理。周游全世界，有好几个女朋友，情绪高涨。诊断躁狂症，经碳酸锂，氯丙嗪治疗后症状消失。神经系统检查无异常，2个月后意识清楚，情感淡漠，话少动作缓慢，不洗澡，不换衣服，记忆力好，无自杀观念，阵发性剧烈头痛，用头撞墙，每次半小时左右，曾癫痫大发作1次，喷射性呕吐1次。神经系检查，眼底视乳头水肿，右侧肢体肌张力增高，巴氏征阳性。脑电图中度异常，大量病理高波幅θ波。左侧较多，脑超声波中线向右移0.3cm。最有意义治疗措施是
A. 抗躁狅治疗
B. 抗抑郁治疗
C. 抗癫痫治疗
D. 手术治疗
E. 抗精神病治疗

正确答案：D。手术治疗

解析：青年男性患者头痛头晕，后出现精神障碍。曾癫痫大发作一次（脑肿瘤病人的癫痫发病率高达30%~50%），喷射性呕吐一次，眼底视神经盘水肿（提示有颅内压增高），右侧肢体肌张力增高，巴氏征阳性（提示神经功能缺损）。脑电图中度异常，大量病理高波幅θ波，左侧较多。故应先考虑为脑肿瘤所致精神障碍。脑肿瘤所致精神障碍，治疗应排除病因，即把肿瘤摘除，精神障碍疾病即可痊愈。故本题选手术治疗（D对）。对位于非优势半球的额、前颞、枕叶或脑室内的有些原发肿瘤（脑膜瘤、室管膜瘤和良性星形细胞瘤）及小脑和视神经的有些良性星形细胞瘤，若能早期发现早期切除，有可能根治。